心力衰竭患者水肿通常出现在
A. 眼睑
B. 双手
C. 颜面
D. 身体最低部位
E. 腹部

正确答案：D。身体最低部位

解析：右心衰竭（九版诊断学P14-P15）导致的心源性水肿发生机制主要是有效循环血量减少，肾血流量减少，继发性醛固酮增多引起钠水潴留以及静脉淤血，毛细血管内静水压增加，组织液回吸收减少所致。其水肿特点是首先出现于身体最低部位（低垂部流体静水压较高）（D对）。出现静脉、淋巴回流障碍时多产生局部性水肿，如双手（B错）水肿。肾源性水肿（九版诊断学P15）多从眼睑（A错）、颜面（C错）开始而延及全身。肝源性水肿主要表现为水肿从腹部（E错）开始，形成大量腹水。